邪入营血证舌象是
A. 舌色淡红
B. 舌质淡白
C. 舌质绛红
D. 舌质紫暗
E. 舌起粗大红刺

正确答案：C。舌质绛红

解析：邪入营分，可见舌绛；邪入血分，可见舌质深绛或紫暗，苔少或无苔，邪入营血证舌象是舌质绛红（C对）。舌色淡红（A错）为正常舌象。舌质淡白（B错），主气血两虚、阳虚。舌质紫暗（D错），多为气血瘀阻。舌起粗大红刺（E错），多为脏腑热极，或血分热盛。